至宝丹长于
A. 化痰开窍，消肿止痛
B. 清热解毒豁痰
C. 芳香开窍，化浊
D. 息风止痉
E. 芳香开窍，温中

正确答案：C。芳香开窍，化浊

解析：至宝丹方中麝香芳香开窍醒神；牛黄豁痰开窍，合犀角清心凉血解毒，共为君药。臣以安息香、冰片辟秽化浊，芳香开窍；玳瑁清热解毒，镇惊安神；由于痰热瘀结，痰瘀不去则热邪难清，心神不安，故佐以朱砂、金箔、银箔镇心安神；雄黄助牛黄豁痰解毒；琥珀助麝香通络散瘀而通心窍之瘀阻，并合朱砂镇心安神。诸药共奏清热开窍，化浊解毒之功（C对）。安宫牛黄丸（牛黄丸）长于清热解毒豁痰（B错）。紫雪长于息风止痉（D错）。